DNA和RNA彻底水解后的产物
A. 戊糖相同，碱基不完全相同
B. 戊糖不完全相同，碱基相同
C. 戊糖相同，碱基也相同
D. 戊糖相同，部分碱基不同
E. 部分戊糖、部分碱基不同

正确答案：E。部分戊糖、部分碱基不同